肱骨髁上骨折最容易出现的晚期并发症是
A. 肱动脉损伤
B. 肘内翻畸形
C. 肘外翻畸形
D. 尺神经损伤
E. 骨折不愈合

正确答案：B。肘内翻畸形

解析：肱骨髁上骨折是指肱骨干与肱骨髁的交界处发生骨折。在肱骨髁内、前方，有肱动脉、正中神经经过，在肱骨髁的内侧有尺神经、外侧有桡神经，均可因肱骨髁上骨折的移位而受到损伤。在儿童期，肱骨下端有骨骺，若骨折线穿过骺板，有可能影响骨骺发育，因而常出现肘内翻或外翻畸形，以肘内翻多见（B对C错）（P635、第三版实用外科学P1938）。骨折并发症分为早期并发症和晚期并发症，早期并发症包括休克、脂肪栓塞综合征、重要内脏器官损伤、重要周围组织损伤（血管、神经、脊髓等）、骨筋膜室综合症，所以肱动脉损伤（A错）与尺神经损伤（D错）为骨折早期并发症（P616）。骨折不愈合（E错）多由于骨折端间嵌夹较多软组织，开放性骨折清创时去除的骨片较多而造成骨缺损，多次手术对骨的血液供应破坏较大及内固定失败等因素所致，肱骨髁上骨折多发生在10岁以下儿童，成人的肱骨髁上骨折较少见，常因较大暴力引起，易发生血液循环障碍，致骨折延迟愈合或不愈合（P627、P635、第二版八年制外科学P934）。